黄连解毒汤主治的是
A. 气分热盛证
B. 热入营分证
C. 热入血分证
D. 三焦火盛证
E. 上中二焦热盛证

正确答案：D。三焦火盛证

解析：黄连解毒汤中以大苦大寒之黄连清泻心火为君，并且兼泻中焦之火；臣以黄芩清上焦之火；佐以黄柏泻下焦之火；栀子清泻三焦之火，导热下行，引邪热从小便而出。四药合用，苦寒直折，泻三焦火毒，主治三焦火毒证（D对）。白虎汤主治气分热盛证（A错）。清营汤主治热入营分证（B错）。犀角地黄汤主治热入血分证（C错）。凉膈散主治上中二焦热盛证（E错）。